以下不属于复合树脂修复的禁忌证的是
A. 不能有效隔离治疗区者
B. 修复体延伸到根面时
C. 前牙Ⅴ类窝洞的修复
D. 深度磨耗或磨牙症患者
E. 如果所有的咬合都位于修复体上时

正确答案：C。前牙Ⅴ类窝洞的修复

解析：本题考查复合树脂修复的禁忌证。以下不属于复合树脂修复的禁忌证的是前牙Ⅴ类窝洞的修复（C错，为本题的正确答案）。1.复合树脂可用于临床上大部分的牙体缺损修复，其广义适应证包括：①Ⅰ～Ⅵ类窝洞的修复；②冠底部和核的构建；③窝沟封闭或预防性修复；④美容性修复，如贴面、牙外形修整、牙间隙封闭；⑤间接修复体的粘接；⑥暂时性修复体；⑦牙周夹板。2.复合树脂修复的禁忌证与隔离和咬合等因素有关，包括：①不能有效隔离治疗区者（A对）；②所有的咬合都位于修复体上时（E对）；③深度磨耗或磨牙症患者（D对）；④修复体延伸到根面时（B对）。